腮腺造影侧位片影像描述哪项是错误的
A. 主导管在下颌升支上方斜向后下行走
B. 主导管长约5cm，管径平均2mm
C. 主导管走行方式以直线形或凹面向上的弧形者多见
D. 分支导管与主导管相连处近于直角
E. 儿童腮腺较小，但导管较粗

正确答案：E。儿童腮腺较小，但导管较粗

解析：本题考查腮腺造影侧位片影像。腮腺造影侧位片可显示腮腺导管系统及腺实质的侧位影像，儿童因腮腺较小，导管亦较细少（E错，为本题的正确答案），在造影片上主导管显示良好，而细小分支导管则显示不明显。一张充盈良好的造影片可显示导管口位于上颌第二磨牙相对颊黏膜处，主导管在下颌升支上方斜向后下行走（A对）。正常主导管长约5cm，最大管径0.9～4.0mm，平均2.0mm（B对）。主导管走行方式以直线形或凹面向上的弧形者多见（C对），表现为乙状形及分叉形者少见。分支导管与主导管相连处近于直角（D对），导管系统在腺体内逐级分支，由粗至细，最后进入腺实质内。